主治肝郁血虚脾弱证的方剂是
A. 一贯煎
B. 逍遥散
C. 四逆散
D. 柴胡疏肝散
E. 痛泻要方

正确答案：B。逍遥散

解析：主治肝郁血虚脾弱证的方剂是逍遥散。功用为疏肝解郁，养血健脾。本方为疏肝养血的代表方，又是妇科调经的常用方（B对）。一贯煎主治肝肾阴虚，肝气郁滞证（A错）。四逆散主治阳郁厥逆证，肝脾气郁证（C错）。柴胡疏肝散主治肝气郁滞证（D错）。痛泻要方主治脾虚肝旺之痛泻（E错）。